血清与血浆的最主要区别在于血清缺乏
A. 纤维蛋白
B. 纤维蛋白原
C. 血小板
D. Ca²⁺
E. 凝血因子

正确答案：B。纤维蛋白原